男性，40岁，不规则发热半年余，反复抗菌无效，明显消瘦，侨居国外多年，临床考虑是否同艾滋病有关，下列检查中更有价值的是
A. 痰培养
B. 胸部CT
C. 血清抗HIV
D. HIV分离
E. CD4/CD8比值，CD4计数

正确答案：C。血清抗HIV

解析：本题考查艾滋病的检查。艾滋病的监测系统包括HIV/AIDS病例报告系统、HIV/AIDS血清学监测系统、HIV相关行为学监测系统和AIDS抗病毒治疗药物的耐药监测系统。本题中临床考虑是否同艾滋病有关，可知下列检查中更有价值的是血清抗HIV（C对ABDE错）。